哪项不是奥美拉唑的不良反应
A. 口干、恶心
B. 头晕、失眠
C. 胃黏膜出血
D. 外周神经炎
E. 男性乳房女性化

正确答案：C。胃黏膜出血